病因研究中要获得工作假设，有一种方法是求异法，例如
A. 某学校发生食物中毒，患者均为进食学生午餐盒饭者，不进食者不发生，因而盒饭为可疑病因
B. 某市发生散发食物中毒多起，调查患者均有进食某熟食店某食品史，该食品为可疑病因
C. 某厂供应的学生午餐饭盒，供应若干学校，各校用餐人数不等，用餐多的学校食物中毒发生人数多，该厂盒饭为可疑病因
D. 某厂供应相同的午餐饭盒给若干学校，仅一个学校发生食物中毒，经调查食物中毒发生在该校自供午餐的班级，因而该厂盒饭并非病因
E. 某市发生食物中毒多起，经化验大多由同一病原微生物所致

正确答案：A。某学校发生食物中毒，患者均为进食学生午餐盒饭者，不进食者不发生，因而盒饭为可疑病因

解析：本题考查求异法。病因研究中要获得工作假设，有一种方法是求异法，例如某学校发生食物中毒，患者均为进食学生午餐盒饭者，不进食者不发生，因而盒饭为可疑病因（A对BCDE错）。求异法认为，比较某现象出现的场合和不出现的场合，如果这两个场合除一点不同外（盒饭），其他情况都相同，那么这个不同点（盒饭）就是这个现象的原因。